左金丸的功能是
A. 滋阴养胃
B. 健脾燥湿
C. 温中散寒，健胃止痛
D. 清热燥湿，行气活血
E. 泻火，疏肝，和胃，止痛

正确答案：E。泻火，疏肝，和胃，止痛